生态系统中的消费者
A. 是异养型微生物
B. 是草食动物
C. 是肉食动物
D. 可起着加工和再生产的作用
E. 能用简单的无机物制造有机物

正确答案：D。可起着加工和再生产的作用

解析：本题考查生态系统中的消费者。在生态系统中，生产者利用太阳光能以简单的无机物制造有机物；消费者依赖生产者而生存，并起着对初级有机物加工、再生产的作用（D对ABCE错）。